易产生耐受性的是
A. 普萘洛尔
B. 维拉帕米
C. 地尔硫䓬
D. 双嘧达莫
E. 硝酸甘油

正确答案：E。硝酸甘油

解析：本题考查硝酸甘油。硝酸甘油（E对）属于硝酸酯类药，任何剂型使用不正确都有可能发生耐药性，且不同类的硝酸酯类存在交叉耐受。普萘洛尔（A错）、维拉帕米（B错）和地尔硫䓬（C错）不易产生耐药性；双嘧达莫（D错）不具有耐药性。